下列描述最为完整的是
A. 国家实行有计划的预防接种制度
B. 国家实行预防接种制度，推行免疫规划
C. 国家实行有计划的预防接种制度，推行免疫规划
D. 国家实行预防接种制度，推行扩大免疫规划
E. 国家实行有计划的预防接种制度，推行扩大免疫规划

正确答案：E。国家实行有计划的预防接种制度，推行扩大免疫规划